诊断试验和筛检试验的评价主要从哪几方面进行
A. 真实性
B. 可靠性
C. 收益
D. 以上均包括
E. 以上均不包括

正确答案：D。以上均包括

解析：诊断试验和筛检试验的评价主要从真实性、可靠性和收益三方面进行。掌握“流行病的诊断和筛检试验及疾病监测”知识点。